社区构成的要素有
A. 有聚居的一群人和一定的地域
B. 有一定的生活服务设施
C. 居民群之间发生种种社会关系
D. 为谋求规章制度具体落实，产生各种社会群体和机构
E. 以上要素都必须具备

正确答案：E。以上要素都必须具备